新月体性肾炎的临床表现是
A. 急性肾小球肾炎
B. 急进性肾小球肾炎
C. 慢性肾小球肾炎
D. 隐匿性肾炎
E. 肾病综合征

正确答案：B。急进性肾小球肾炎